左旋多巴抗帕金森病的作用机制是
A. 在外周脱羧变成多巴胺起作用
B. 促进脑内多巴胺能神经释放递质起作用
C. 进入脑后脱羧生成多巴胺起作用
D. 在脑内直接激动多巴胺受体
E. 在脑内抑制多巴胺再摄取

正确答案：C。进入脑后脱羧生成多巴胺起作用